甘草配伍白芍的主要目的是
A. 缓和药性
B. 调和诸药
C. 调和营卫
D. 和中解毒
E. 缓急止痛

正确答案：E。缓急止痛

解析：本题考查的是甘草的配伍。甘草配伍白芍的主要目的是缓急止痛（E对）。甘草：【功效】益气补中，祛痰止咳，解毒（D错），缓急止痛，缓和药性（A错）。【主治病证】（1）心气虚之心动悸、脉结代。（2）脾虚乏力、食少便溏。（3）咳嗽气喘。（4）疮痈肿毒，食物或药物中毒。（5）脘腹或四肢挛急疼痛。（6）调和诸药（B错）。【配伍】甘草配白芍：甘草味甘，功能补气缓急；白芍酸收，功能养血柔肝。两药相合，缓急止痛力强，治脘腹或四肢拘急疼痛。桂枝：【配伍】桂枝配白芍：桂枝辛甘性温，功能发表助阳、温通经脉；白芍酸甘微寒，功能养血敛阴止汗。两药相配，收散并举，共奏调和营卫（C错）、散风敛营、解肌发表之功，治风寒表虚有汗每用。